病人坚信配偶对自己不忠贞，另有新欢，因而经常跟踪监视配偶的日常活动，这种表现属于
A. 影响妄想
B. 关系妄想
C. 钟情妄想
D. 嫉妒妄想
E. 被害妄想

正确答案：D。嫉妒妄想

解析：嫉妒妄想（D对）病人坚信配偶对自己不忠贞，另有新欢，因而经常跟踪监视配偶的日常活动。影响妄想（A错）又称被控制感，患者感到自己的思想、情感或意志行为受到某种外界力量的控制而身不由己。如患者经常描述被红外线、电磁波、超声波或某种特殊的先进仪器控制。关系妄想（B错）患者认为周围环境中所发生均与自己有关。如病人认为同事之间聊天时在议论他，别人咳嗽是在唾骂他。钟情妄想（C错）患者坚信自己被某异性或许多异性钟情，对方的一言一行都是对自己爱的表达。被害妄想（E错）患者坚信自己被某些人或某组织进行迫害，如投毒、跟踪、监视、诽谤等。